染色体数目异常出现三体可记为
A. 2n－1
B. 2n＋1
C. 2n＋3
D. 2n－3

正确答案：B。2n＋1

解析：本题考查染色体数目异常。染色体数目异常出现三体可记为2n＋1（B对ACD错）。